对急诊患者，当手术是抢救患者的唯一方案时，最符合医学道德的做法是
A. 首先考虑患者的选择
B. 立即进行手术
C. 在征得其家属或单位同意后，立即进行手术
D. 放弃手术
E. 患者拒绝手术时可不手术

正确答案：C。在征得其家属或单位同意后，立即进行手术

解析：保证患者的知情同意权。首先，保证知情。医务人员应以患者及家属可理解的语言，实事求是地向患者及其家属认真分析并说明病情，对于选择手术和非手术治疗的原因及采用各种治疗手段可能产生的后果，以及不同治疗方案的效果和代价予以介绍。其次，征得同意。由于手术治疗本身具有风险性和创伤性，在介绍、分析有关情况的同时，要充分哼重患者或其家属的选择，保护患者的利益，取得患者或其家属的同意。再次，签订知情同意书。在患者及其家属知情的基础上征得同意，还需要让其签订同意实施麻醉和手术的书面协议。手术前的这一工作无论从治疗程序，还是从法律、伦理上来说都是必不可少的（C对B错）。患者并不具备急诊抢救的专业知识，应当由医生综合考量后与患者及其家属协商治疗方案（A错）。医生应当采取适当治疗方式拯救患者，包括手术治疗，情况紧急时当立即进行手术，而不是放弃治疗（DE错）。